成年人急性失血，至少一次失血量超过总血量多少才能引起休克？
A. 0.5
B. 0.4
C. 0.3
D. 0.2
E. 0.15

正确答案：D。0.2

解析：成年人在15分钟内快速大量失血超过总血量的0.2(约1000ml)（D对C错），则超出了机体的代偿能力，即可引起心排血量和平均动脉压下降而发生失血性休克。一般15 ~ 20分钟内失血少于全身总血量的0.1 ~ 0.15（E错）时，机体可通过代偿使血压和组织灌流量基本保持在正常范围内。如果失血量超过总血量的0.45 ~0.5（AB错）, 会很快导致死亡。